不属器官特异性自身免疫病的是
A. 慢性甲状腺炎
B. 恶性贫血
C. 重症肌无力
D. 特发性血小板减少性紫癜
E. 类风湿性关节炎

正确答案：E。类风湿性关节炎

解析：器官特异性自身免疫病是组织器官的病理损害和功能障碍仅限于抗体或致敏淋巴细胞所针对的某一器官。主要有慢性淋巴性甲状腺炎（A对）、恶性贫血（B对）、重症肌无力（C对）、特发性血小板减少性紫癜（D对）、胰岛素依赖型糖尿病、甲状腺功能亢进、慢性溃疡性结肠炎、肺出血肾炎综合征、寻常天皰疮、类天皰疮、原发性胆汁性肝硬变、多发性脑脊髓硬化症、急性特发性多神经炎等。类风湿性关节炎属于全身性的自身免疫病（E错，为本题正确答案）。